检查以下杂质应使用的试剂是:氯化物
A. 硫氰酸铵
B. 硫酸
C. 硫代乙酰胺
D. 氯化钡
E. 硝酸银

正确答案：E。硝酸银